治疗前头痛风邪袭络证，应首选
A. 风池、太冲、合谷、内关、后溪
B. 风池、百会、悬颅、侠溪、行间
C. 上星、头维、合谷、阿是穴
D. 百会、通天、行间、阿是穴
E. 率谷、太阳、侠溪、内庭

正确答案：C。上星、头维、合谷、阿是穴

解析：前头痛风邪袭络证，应疏调经脉，通络止痛，前头是阳明经头痛 选上星、头维、合谷、阿是穴，以手阳明经穴和局部腧穴为主，旨在疏通相应部位的经络，含通则不痛之意（C对）。合谷可用于阳明（前额）头痛，后溪可用于太阳头痛，内关可治瘀血头痛（A错）。此组以足厥阴经脉和足少阳经脉的腧穴为主，取两经之病部与循经远取相配以平熄亢逆之风阳，用于头痛肝阳上亢证（B错）。百会、通天、行间、阿是穴可用于风邪袭络之厥阴头痛（颠顶痛）（D错）。率谷、太阳、侠溪可用于风邪袭络之侧头部痛（E错）。